临床上常用驱虫药物哪项最常用
A. 吡喹酮
B. 甲苯咪唑
C. 肠虫清
D. 硫酸二氯酚
E. 喹诺酮类

正确答案：A。吡喹酮